上颌骨骨折颌间固定的时间是
A. 1-2周
B. 8周
C. 3-4周
D. 5-6周
E. 以X线片上有骨痂形成为准

正确答案：C。3-4周

解析：本题考查颌间固定的时间。上颌骨骨折颌间固定的时间是3-4周（C对）。为保证骨折块复位后在正常位置上愈合，防止发生再移位，必须及时固位、保证充足的固位时间。上颌骨骨折颌间固定时间是3～4周。骨折固定时间不足，上颌骨发生牵拉移位影响愈合（A错）；固定时间太长，影响患者口腔卫生、进食与语音（BD错）。骨痂形成的时间大约是骨折2周后，且不能作为固定时间的标准（E错）。